劳动过程中的有害因素，不包括
A. 不合理的生产工艺
B. 使用不合理的工具
C. 劳动制度不合理
D. 精神性职业紧张
E. 劳动强度过大

正确答案：A。不合理的生产工艺

解析：本题考查劳动过程中的有害因素。劳动过程中的有害因素包括：1.劳动组织和制度不合理、劳动作息制度不合理（C对）等；2.精神（心理）性职业紧张（D对）；3.劳动强度过大（E对）或生产定额不当；4.个别器官或系统过度紧张；5.长时间处于不良体位、姿势或使用不合理的工具（B对）等；6.不良的生活方式。不合理的生产工艺（A错，为本题正确答案）属于生产环境中的有害因素，与题意无关。